将某一个体因治疗需要拔除的健康牙，移植到另一个体的牙槽窝内，这种方法是
A. 自体牙移植术
B. 异体牙移植术
C. 即刻再植
D. 延期再植
E. 牙种植术

正确答案：B。异体牙移植术

解析：异体牙移植术，是将某一个体因治疗需要拔除的健康牙，移植到另一个体的牙槽窝内。临床上是用同种异体牙进行移植的。掌握“牙槽外科”知识点。